下列关于颈总动脉的描述，错误的是
A. 为口腔颌面部血液供应的主要来源
B. 在舌骨水平分为颈内动脉和颈外动脉
C. 左侧颈总动脉起自主动脉弓
D. 右侧颈总动脉起自无名动脉
E. 左侧颈总动脉比右侧长

正确答案：B。在舌骨水平分为颈内动脉和颈外动脉

解析：本题考查颈总动脉。下列关于颈总动脉的描述，错误的是在舌骨水平分为颈内动脉和颈外动脉（B错，为本题的正确答案）。面颈部的动脉来源于颈总动脉和锁骨下动脉，颈总动脉是颈前部、口腔颌面部、颅顶及硬脑膜等处的动脉主干，为口腔颌面部血液供应的主要来源（A对）。颈总动脉约在甲状软骨上缘水平分为颈内和颈外动脉，颈内动脉入颅前无分支，而颈外动脉有无数个分支，这是颈部手术中辨别颈内与颈外动脉的重要标志。左侧颈总动脉比右侧长（E对），起自主动脉弓（C对），右侧颈总动脉起自无名动脉（头臂干）（D对）。